正确的有
A. 前缘游离，后缘附有系膜
B. 内侧端连子宫
C. 外侧端连输卵管
D. 后缘中央有一裂隙称卵巢门
E. 性成熟期卵巢最大

正确答案：E。性成熟期卵巢最大

解析：卵巢前缘借卵巢系膜连于阔韧带称为卵巢系膜缘, 后缘游离称为独立缘（A错），前缘中部有血管、神经等出入，称为卵巢门（D错）。内侧面朝向盆腔，与小肠相邻（B错），外侧面贴着骨盆侧壁的卵巢窝（C错），性成熟期卵巢最大（E对）。